下列脊椎病变，除哪项外，脊椎叩痛常为阳性
A. 脊椎结核
B. 棘间韧带损伤
C. 骨折
D. 骨质增生
E. 椎间盘脱出

正确答案：D。骨质增生

解析：脊椎叩痛阳性可见于脊柱结核（A对）、韧带损伤（B对）、骨折（C对）、椎间盘突出等（E对）。骨质增生主要表现为活动受限、病变处酸痛、胀痛，而无叩击痛（D错，为本题正确答案）。